感光最敏锐的部位是
A. 瞳孔
B. 巩膜静脉窦
C. 虹膜角膜角
D. 视神经盘
E. 黄斑中央凹

正确答案：E。黄斑中央凹

解析：感光最敏锐的部位是黄斑中央凹（E对），视神经盘（D错）是生理性盲点。